环境污染对健康影响的特点不包括
A. 受影响人群一般很广泛
B. 常常引起慢性中毒
C. 污染物通过多途径进入人体
D. 不同个体对污染物的反应不同
E. 消除污染后健康损害即可恢复

正确答案：E。消除污染后健康损害即可恢复

解析：环境污染对健康影响的特点（预防医学第三版P14）：1.广泛性。环境污染影响范围大（A错），涉及人口多，对象广泛（老、弱、病、幼、胎儿等）。2.长期性。环境污染物可长时间作用于人群，甚至终生。如果污染物在环境中的剂量（浓度）相对较小，有害作用在短期内不易显现，容易被人们忽视，因而会酿成更严重的后果。3.多样性。污染物对人体健康的损害作用，有特异性损害，又有非特异性损害（D错），有局部的，又有全身的，有急性的，又有慢性的（B错），既有近期的，又有远期的（E对），因此需要全面调查，进行综合评价。4.	复杂性。环境污染物在环境中可以多种同时共存，作为环境致病因素造成人类健康损害属多因多果性，关系复杂，故要特别注意各种因素的联合作用（C错）。